氰化氢致机体中毒的主要特点是
A. 和血液中Hb结合，影响O₂的运输
B. 血液中虽被O₂饱和，但不能被组织利用
C. 抑制体内多种酶的活性
D. 抑制胆碱酯酶的活性
E. 降低脑和肝中ATP酶的活性，使细胞缺O₂

正确答案：B。血液中虽被O₂饱和，但不能被组织利用